男，35岁，其妻在一场车祸中丧生，其后患者表现为依赖性增强，兴趣变得狭窄，以自我为中心。心理医生认为患者的表现属于应激反应。这类应激反应属
A. “或战或逃”反应
B. 行为退缩反应
C. 认知反应
D. 自我防御反应
E. 情绪反应

正确答案：B。行为退缩反应

解析：本患者在经历创伤事件（其妻在一场车祸中丧生）后，表现为依赖性增强，兴趣变得狭窄，以自我为中心，是行为退化反应的特点，所以本患者最可能的应激类型为行为退化反应（B对）。